用于评价药物急性中毒的参数
A. pKₐ
B. ED₅₀
C. LD₅₀
D. LgP
E. HLB

正确答案：C。LD₅₀

解析：本题考查药代动力学参数。用于评价药物急性中毒的参数是LD₅₀（半数致死量）（C对）。半数致死量（LD₅₀）是指引起50%试验动物死亡的剂量。半数有效量是指引起50%阳性反应（质反应）或50%最大效应（量反应）的浓度或剂量，分别用半数有效量（ED₅₀）（B错）及半数有效浓度（EC₅₀）表示。pKₐ（A错）在化学及生物化学中，是指一个特定的平衡常数，以代表一种酸离解氢离子的能力，是由其化学结构决定的。LgP（D错）用于评价药物脂溶性。HLB（E错）是用于评价表面活性剂的参数。